口底多间隙感染的病原菌常常为
A. 主要是葡萄球菌、链球菌
B. 主要是厌氧性、腐败坏死性细菌
C. 主要是需氧菌
D. 混合性菌群，除葡萄球菌、链球菌外，还可见产气荚膜杆菌、厌氧链球菌、败血梭形芽孢杆菌等
E. 大肠菌群和需氧菌

正确答案：D。混合性菌群，除葡萄球菌、链球菌外，还可见产气荚膜杆菌、厌氧链球菌、败血梭形芽孢杆菌等

解析：口底多间隙感染的病原菌常常为混合性菌群，除葡萄球菌、链球菌外，还可见产气荚膜杆菌、厌氧链球菌、败血梭形芽孢杆菌、水肿梭形芽孢杆菌、产气梭形芽孢杆菌以及溶解梭形芽孢杆菌等。掌握“口底多间隙感染”知识点。